“想吃糖，又怕胖”，这种动机冲突是
A. 双趋冲突
B. 双避冲突
C. 趋避冲突
D. 双重趋避冲突
E. 双趋双避冲突

正确答案：C。趋避冲突

解析：趋避冲突：指某个目标对个体既有吸引力，又有排斥力的情况下，个体对该目标既向往又拒绝的心理冲突。所谓“想吃鱼又怕腥”，既想又怕，就是这种冲突的表现。掌握“需要与动机”知识点。